关于健康教育评价意义的表述，不正确的是
A. 是取得成功的必要保障
B. 可以科学地说明计划的价值
C. 可以减少计划实施过程的偏差
D. 扩大项目对社区的影响
E. 提高健康教育专业人员的理论与实践水平

正确答案：C。可以减少计划实施过程的偏差